男性，突然寒战、高热，咳嗽，咳少量黏液痰，时有铁锈色痰，下列哪种疾病可能性大
A. 支气管炎
B. 病毒性肺炎
C. 支原体肺炎
D. 肺炎球菌肺炎
E. 肺炎杆菌肺炎

正确答案：D。肺炎球菌肺炎

解析：男性，突然寒战、高热、咳嗽，咳少量粘液痰，时有铁锈色痰（为肺炎链球菌肺炎的典型痰液表现）等符合肺炎球菌肺炎的临床表现，故该患者患有肺炎球菌肺炎（D对）的可能性大。支气管炎（A错）的患者缓慢起病，病程长，主要症状为咳嗽、咳痰，或伴有喘息，一般为白色黏痰和浆液泡沫性痰，清晨排痰较多等。病毒性肺炎（P51）（B错）好发于病毒疾病流行季节，症状通常较轻，起病较急，常在急性流感症状尚未消退时即出现咳嗽、少痰、或白色黏液痰、咽痛等呼吸道症状，故该患者不考虑此病。支原体肺炎（P49）（C错）起病较缓慢，咳嗽多为阵发性刺激性呛咳，咳少量黏痰。肺炎杆菌肺炎（E错）的患者症状多较为严重，如患有克雷伯杆菌肺炎的患者起病急、寒战、高热、全身衰竭，咳痰为砖红色胶冻状。